患者，男，58岁，高血压病史5年；吸烟史40年，日均40支。6小时前出现左侧肢体无力，并逐渐加重，不能站立；家属发现其说话迟钝，言语含混，右侧嘴唇变浅；意识清楚。到某院急诊，BP190/120mmHg；血常规基本正常，行头部MRI检查后，诊断为急性脑梗死。经过对症支持治疗，患者恢复良好，出院后应接受的长期预防药物的首选是
A. 华法林片3mg qd po
B. 阿司匹林肠溶片300mgqd po
C. 阿司匹林肠溶片200mg qd po
D. 氯吡格雷片75mgqd po
E. 氯吡格雷片200mg qd po

正确答案：C。阿司匹林肠溶片200mg qd po

解析：本题考查药物的用法。出院后应接受的长期预防药物的首选是阿司匹林肠溶片200mg qd po（C对）。华法林（A错）适用于预防和治疗血栓栓塞性疾病。对不能耐受阿司匹林者，可考虑选用氯吡格雷（B错）等抗血小板治疗。注射用阿替普酶（E错）为急性脑梗死的首选治疗方案。